输尿管
A. 起自肾盂，终于膀胱
B. 按行程可分腹部（段）和盆部（段）
C. 第2个狭窄位于其盆部（段）穿膀胱壁处
D. 在女性，输尿管跨越子宫动脉的前上方
E. 无

正确答案：A。起自肾盂，终于膀胱

解析：输尿管起自肾盂末端，终于膀胱（A对），全长可分为腹部、盆部和壁内部（B错）。女性输尿管盆部跨越子宫动脉的后下方（D错）。输尿管有三处狭窄，其中第2个狭窄位于小骨盆上口，输尿管跨过髂血管处，穿膀胱壁处为第三处狭窄（C错）。